携带细菌绝大多数遗传信息，决定细菌基因型的是
A. 染色体
B. 质粒
C. 毒力岛
D. 转座子
E. 前噬菌体

正确答案：A。染色体